听宫穴的定位是
A. 在面部，耳屏上切迹与下颌骨髁突之间的凹陷中
B. 在面部，耳屏间切迹与下颌骨髁突之间的凹陷中
C. 在面部，耳屏正中与下颌骨髁突之间的凹陷中
D. 在面部，颧弓下缘中央与下颌切迹之间的凹陷中
E. 在面部，下颌角前上方一横指，按之凹陷中

正确答案：C。在面部，耳屏正中与下颌骨髁突之间的凹陷中

解析：听宫穴定位于耳屏正中与下颌切迹之间的凹陷中（C对）。耳门定位于耳屏上切迹与下颌骨髁突之间的凹陷中（A错）。听会定位于耳屏间切迹与下颌骨髁突之间的凹陷中（B错）。下关定位于颧弓下缘中央与下颌切迹之间的凹陷中（D错）。颊车穴定位于下颌角前上方一横指，按之凹陷中（E错 ）。